小肠低位肠梗阻时不可能的是
A. 呕吐出现早、量大
B. 腹部平片有阶梯气液平
C. 阵发腹痛和腹胀
D. 脐周有气过水声
E. 呕吐粪样内容物

正确答案：A。呕吐出现早、量大

解析：小肠低位肠梗阻时呕吐出现晚而次数少（A错，为本题正确答案），而腹部平片有阶梯气液平（B对）、阵发腹痛和腹胀（C对）、脐周有气过水声（D对）与呕吐粪样内容物（E对）都有可能出现。